《中华人民共和国药品管理法》规定，生产药品所需的原、辅料必须符合
A. 药理标准
B. 化学标准
C. 食用标准
D. 药用要求
E. 生产要求

正确答案：D。药用要求

解析：本题考查《中华人民共和国药品管理法》。《中华人民共和国药品管理法》规定，生产药品所需的原、辅料必须符合药用要求（D对）。《药品管理法》规定，医疗机构配制制剂，应当有能够保证制剂质量的设施、管理制度、检验仪器和卫生环境。医疗机构配制制剂，应当按照经核准的工艺进行，所需的原料、辅料和包装材料等应当符合药用要求。